史国公药酒的功能是
A. 活血散瘀，消肿止痛
B. 补肾益气，活血壮骨
C. 祛风除湿，活血通络
D. 滋补肝肾，活络止痛
E. 养血荣筋，祛风通络

正确答案：C。祛风除湿，活血通络

解析：本题考查的是史国公药酒的功能。史国公药酒的功能是祛风除湿，活血通络祛风除湿，活血通络（C对）。史国公药酒【功能】祛风除湿，活血通络。云南白药酊【功能】活血散瘀，消肿止痛（A错）。骨疏康颗粒【功能】补肾益气，活血壮骨（B错）。舒筋健腰丸【功能】补益肝肾，强健筋骨，驱风除湿，活络止痛（D错）。养血荣筋丸【功能】养血荣筋，祛风通络（E错）。